属于分布区域缩小，资源处于衰竭状态的重要野生药材是
A. 羚羊角
B. 石斛
C. 蛤蚧
D. 蟾酥
E. 斑蝥

正确答案：C、D。蛤蚧；蟾酥

解析：本题考查野生药材物种。属于分布区域缩小，资源处于衰竭状态的重要野生药材是蛤蚧（C对）、蟾酥（D对）。二级保护野生药材物种系指分布区域缩小，资源处于衰竭状态的重要野生药材物种。二级保护药材名称：鹿茸（马鹿）、麝香（3个品种）、熊胆（2个品种）、穿山甲、蟾酥（2个品种）、哈蟆油、金钱白花蛇、乌梢蛇、蛤蚧、甘草（3个品种）、黄连（3个品种）、人参、杜仲、厚朴（2个品种）、黄柏（2个品种）、血竭。一级保护野生药材物种系指濒临灭绝状态的稀有珍贵野生药材物种。羚羊角（A错）为一级保护野生药材物种。三级保护野生药材物种系指资源严重减少的主要常用野生药材物种。石斛（B错）属于三级保护野生药材物种。斑蝥（E错）为毒性药品中药品种。